患者腹大胀满，按之如囊裹水，胸脘胀闷，得热稍舒，精神困倦，怯寒懒动，小便少，大便溏，苔白腻，脉濡。其治疗的主方为
A. 调营饮
B. 胃苓汤
C. 实脾饮
D. 柴胡疏肝散
E. 中满分消丸

正确答案：C。实脾饮

解析：由于脾阳不振，寒湿停聚，水蓄不行，故见腹大胀满，按之如囊裹水；寒水相搏，中阳不运，故胸脘胀闷，得热稍舒；脾为湿困，阳气失于舒展，故见精神困倦，怯寒懒动；寒气困脾，兼伤肾阳，水液不行，故见小便少，大便溏；苔白腻，脉濡，均为臌胀之寒湿困脾证之侯，治法为温中散寒，行气利水，方药选用实脾饮加减（C对）。调营饮（A错）可以活血化瘀，化气行水，用于治疗肝脾血瘀证。胃苓汤（B错）合柴胡疏肝散（D错）可以疏肝理气，健脾化湿，用于治疗气滞湿阻证。中满分消丸（E错）可以清热利湿，攻下逐水，用于治疗湿热蕴脾证。